腓骨颈骨折最有可能损伤的神经是
A. 坐骨神经
B. 胫神经
C. 腓总神经
D. 腓浅神经
E. 无

正确答案：C。腓总神经

解析：坐骨神经（A错）易损伤部位为盆腔部。胫神经（B错）易损伤部位为内髁后方。腓总神经（C对）在腓骨颈处的位置最为表浅易受损伤。